30岁男性，30分钟前被刀刺右前胸部，咳血痰，呼吸困难。体检：血压107/78mmHg，脉搏96次/分，右前胸有轻度皮下气肿，右锁骨中线4肋间可见3cm长创口，随呼吸有气体进出伤口响声。该病人纵隔的位置是
A. 右偏
B. 左偏
C. 正中位
D. 在右侧与正中间摆动
E. 在左侧与正中间摆动

正确答案：E。在左侧与正中间摆动

解析：青年男性患者，右前胸部刀刺伤，可见创口，有气体进出响声，且右前胸有皮下气肿，结合患者病史和临床表现，考虑该患者为开放性气胸。开放性气胸患者伤侧胸内压等于大气压，吸气时健侧胸内压低于大气压，使得纵隔移向健侧（左侧），呼气时正好相反。由于呼气末胸内压等于大气压，所以纵隔于呼气末重新回到正中位置，不会越过中线至伤侧。综上，该病人的纵隔会在左侧与正中间摆动（E对）。